单纯性疱疹病毒易侵犯的部位不包括
A. 口腔
B. 皮肤
C. 眼
D. 神经系统
E. 消化道

正确答案：E。消化道

解析：本题考查单纯性疱疹病毒易侵犯的部位。单纯性疱疹病毒易侵犯的部位不包括消化道（E错，为本题的正确答案）。单纯疱疹是由单纯疱疹病毒所致的皮肤黏膜病，临床上以簇集性小水疱为特征，有自限性，易复发。人类是单纯疱疹病毒的天然宿主，单纯性疱疹病毒易侵犯口腔（A对）、皮肤（B对）、眼（C对）、会阴部及神经系统（D对）易受累，但不会侵犯消化道。